女婴，6个月。咳嗽伴喘憋2天，查体：T38℃，P120次/分，R80/分，烦躁不安，双肺明显哮鸣音，喘息缓解时可闻及少许中、小湿啰音，肝助下2.0cm。最可能的诊断是
A. 肺炎链球菌肺炎
B. 腺病毒肺炎
C. 呼吸道合胞病毒肺炎
D. 肺炎支原体肺炎
E. 金黄色葡萄球菌肺炎

正确答案：C。呼吸道合胞病毒肺炎

解析：6个月患儿（婴幼儿高发），咳嗽伴喘憋2天（起病较急），查体：T38℃（中度发热），P120次/分，R80/分，烦躁不安，双肺明显哮鸣音，喘息缓解时可闻及少许中、小湿啰音（明显肺炎体征），肝助下2.0cm，最可能的诊断是呼吸道合胞病毒肺炎（C对）。